用药剂量过大或时间过长时，可引起急性肾功能衰竭的拟肾上腺素药是
A. 肾上腺素
B. 去甲肾上腺素
C. 异丙肾上腺素
D. 间羟胺
E. 多巴胺

正确答案：B。去甲肾上腺素

解析：去甲肾上腺素（B对）属于α受体激动剂，能够激动血管α₁受体，血管收缩，主要是小动脉和小静脉收缩，其中皮肤、黏膜血管收缩最为明显，其次是肾血管，滴注时间过长或剂量过大，可使肾脏血管强烈收缩，产生少尿、无尿和肾实质损伤，引起急性肾功能衰竭。肾上腺素（A错）属于α、β受体激动药，其主要不良反应为心悸、烦躁、头痛和血压升高等，有诱发脑溢血的危险，老年人慎用，可引发心律失常，甚至心室纤颤，肺水肿。异丙肾上腺素（C错）属于β受体激动剂，对α受体无作用，不良反应以心悸、头晕、皮肤潮红多见，过量易引起心律失常。间羟胺（D错）可直接激动α受体，对肾血管收缩作用较去甲肾上腺素平缓，较少引起少尿的不良反应。多巴胺（E错）临床用于治疗各种休克，不良反应一般较轻，剂量过大或滴注过快，可出现心律失常、心动过速和肾血管收缩引起的肾功能下降，一般不引起急性肾功能衰竭。